不正确的为
A. 在口角平面以上无静脉瓣
B. 与海绵窦相通
C. 注入颈外静脉
D. 构成“危险三角”区
E. 与面动脉伴行

正确答案：C。注入颈外静脉

解析：面静脉在口角平面以上无静脉瓣（A对）。通过眼上静脉和眼下静脉与颅内的海绵窦交通（B对）。注入颈内静脉（C错，为本题正确答案）。构成“危险三角”区（D对）。与面动脉伴行（E对）。